患者，女，22岁，未婚。经期延后，量少、色黯、有血块，腹痛喜热，畏寒，舌暗苔白，脉沉紧。其治法是
A. 暖宫止痛凋经
B. 理气止痛调经
C. 活血行气调经
D. 扶阳祛寒调经
E. 温经散寒调经

正确答案：E。温经散寒调经

解析：患者月经后期，并伴有量少，腹痛喜热，畏寒，舌暗苔白，脉沉紧等寒症表现，故治疗时要温经散寒，调经（E对）。暖宫止痛调经多用于肾阳虚，小腹冷痛，喜暖拒按（A错）。理气止痛调经多用于气滞证，调理气机，通经止痛（B错）。活血行气止痛多用于气滞血瘀证，活血行气通经止痛（C错）。扶阳祛寒止痛多用于虚寒证，固护阳气，温煦机体（D错）。